的淋巴
A. 胃
B. 阑尾
C. 肝
D. 空、回肠
E. 膀胱

正确答案：E。膀胱

解析：膀胱的淋巴结由髂外淋巴结收集（E错）。肠干可收集胃（A对)、阑尾（B对）、肝（C对）、空肠及回肠（D对）的淋巴。